以下腧穴中，治疗疔疮的要穴是
A. 陶道
B. 大椎
C. 身柱
D. 腰阳关
E. 风府

正确答案：C。身柱

解析：身柱属于督脉腧穴，位于第3胸椎棘突下凹陷中，后正中线上。身柱主治：①身热、头痛、咳嗽、气喘等外感病证②惊厥、癫狂痫等神志病③腰脊强痛④疔疮发背（C对）。陶道主治：①热病、疟疾、恶寒发热、咳嗽、气喘等外感病证②骨蒸潮热③癫狂④脊强（A错）。大椎主治：①热病、疟疾、恶寒发热、咳嗽、气喘等外感病证②骨蒸潮热③癫狂痫证、小儿惊风等神志病④项强，脊痛⑤风疹，痤疮（B错）。腰阳关主治：①腰骶疼痛，下肢痿痹②月经不调、赤白带下等妇科病证③遗精、阳痿等男科病证（D错）。风府主治：①中风、癫狂病、癔症等内风为患的神志病②头痛、眩晕、颈项强痛、咽喉 肿痛、失音、目痛、鼻衄等头颈、五官病证（E错）。